常用的脱色剂是
A. 二氧化硅
B. 二氧化碳
C. 活性炭
D. 氯仿
E. 乙醇

正确答案：C。活性炭

解析：本题考查的是常用的脱色剂。常用的脱色剂是活性炭（C对）。活性炭是非极性吸附剂，与硅胶、氧化铝相反，对非极性物质具有较强的亲和能力，在水中对溶质表现出强的吸附能力。在结晶及重结晶过程中加入活性炭进行的脱色、脱臭等操作，这在物质精制过程中应用很广。二氧化硅（A错）可做混悬剂的助悬剂。二氧化碳（B错）可作为超临界流体的物质。已知可作为超临界流体的物质很多，如二氧化碳、一氧化二氮、六氟化硫、乙烷、庚烷、氨、二氯二氟甲烷等，其中以二氧化碳最为常用。氯仿（D错）为亲脂性溶剂。乙醇（E错）为强极性溶剂。